患者，女，50岁，教师，右下肢沉重酸胀2年余，检查可见：右下肢浅静脉隆起迂曲，状如蚯蚓为确诊，应作的检查是
A. 多普勒肢体血流图
B. 静脉造影
C. 红外热像仪测定
D. 肢体光电容积描记
E. 血液流变学检查

正确答案：B。静脉造影

解析：患者右下肢浅静脉隆起迂曲，状如蚯蚓，诊断为下肢静脉曲张。静脉造影，通过静脉造影可以显示深静脉瓣膜功能及隐股静脉瓣膜功能和深浅静脉交通支、静脉曲张的走行，同时对手术起到良好的指导作用（B对）。超声多普勒血管超声，检查浅静脉迁曲程度、隐股静脉瓣膜和深静脉瓣膜及通畅情况（A错）。对比同一水平面两侧肢体的温度差别，当某部皮温较对侧及同侧其它部位明显降低时（相差大于2℃），则提示该部动脉血流减少，如动脉栓塞、慢性动脉闭塞性疾病。若某部皮温较对侧及同侧其它部位明显升高，则提示该部动脉或静脉血流增加，如深静脉血栓形成、红斑性肢痛病、动静脉瘘等。测定皮温的方法为红外线热像仪（C错）。肢体光电容积描记，静脉回复时间正常提示大小隐静脉瓣功能不全，静脉回复时间不正常提示病变部位不在浅静脉，病人可能存在深静脉病变（D错）。血液流变学检查，可以反映患者血液黏度等数项指标，提示血液流变性改变（E错）。